紫雪长于
A. 化痰开窍，消肿止痛
B. 清热解毒豁痰
C. 芳香开窍，化浊
D. 息风止痉
E. 芳香开窍，温中

正确答案：D。息风止痉

解析：紫雪方中犀角清心凉血解毒；羚羊角长于凉肝息风止痉；麝香芳香，开窍醒神，共为君药。生石膏辛甘大寒，清热泻火，除烦止渴；寒水石辛咸大寒，清热泻火，除烦止渴；滑石甘淡而寒，清热利窍，引热下行，三药并用，清热泻火为臣药。佐以玄参甘苦咸寒，滋阴清热凉血；升麻甘辛微寒，清热解毒，透热达邪；青木香、丁香、沉香辛温芳香，行气通窍；黄金镇心安神，平肝息风，解毒；朱砂、磁石重镇安神；更用朴硝、硝石泄热散结，使邪热从肠腑下泄，炙甘草益气安中，调和诸药，并防寒凉伤胃之弊，为佐使药。诸药合用共奏清热开窍，息风止痉之效（D对）。安宫牛黄丸（牛黄丸）长于清热解毒豁痰（B错）。至宝丹长于芳香开窍，化浊（C错）。